可能引起氟中毒的人体摄入剂量是
A. 5mg/kg
B. 10mg/kg
C. 15mg/kg
D. 20mg/kg
E. 25mg/kg

正确答案：A。5mg/kg

解析：本题考查可引起氟中毒的氟摄入量。5mgF-/kg（A对）的氟摄入量很有可能会引起中毒症状和体征，严重者可致死。